肺主一身之气的功能，主要体现于
A. 肺吸入清气，布散周身
B. 宣发卫气于体表，以保卫机体
C. 呼出体内浊气，以吐故纳新
D. 宗气的生成和对气机的调节
E. 助心行血

正确答案：D。宗气的生成和对气机的调节

解析：肺主一身之气是指肺主司一身之气的生成和运行的功能。①生成：肺司呼吸，吸入自然界的清气，而清气是人体之气的重要来源之一，尤其体现于宗气的生成。宗气由肺吸入的自然界清气与脾胃运化的水谷之精化生的水谷之气在肺中相结合而成。②运行：一身之气皆受肺之统领（D对）；肺气宣发，指肺气升宣与布散的运动形式，与肺主清肃相对而言。主要体现在三个方面：一是呼出体内浊气；二是将脾转输至肺的水谷精微和津液上输头面诸窍，外达皮毛肌腠理；三是宣发卫气于皮毛肌腠，以温分肉，充皮肤，肥腠理，司开阖，并将津液化为汗液排出体外。肺气肃降，指肺气清肃与下降的运动形式，与肺主宣发相对而言，体现在三个方面：一是吸入自然界清气，下纳于肾，以资元气；二是将脾转输至肺的水谷精微和津液向内向下布散，下输于肾，成为尿液生成之源；三是肃清肺和呼吸道内的异物，保持呼吸道的洁净。所以肺吸入清气，布散周身、宣发卫气于体表，以保卫机体、呼出体内浊气，以吐故纳新是肺气宣发肃降功能的体现（ABC错）；肺朝百脉，指全身的血液，都要通过经脉而会聚于肺，经肺的呼吸进行气体交换，而后输布于全身，即肺气助心行血的生理功能，所以助心行血是肺朝百脉的体现（E错）。